甲是药品上市许可持有人，依法持有甲钴胺片等药品品种；乙是药品生产企业，生产范围：片剂，胶囊剂；丙是药品生产企业，生产范围：胶囊剂，颗粒剂；丁是全国性药品批发企业，经营范围：麻醉药品、中成药、中药饮片、化学药、生物制品，具备药品现代物流条件；戊是县级区域性药品批发企业，经营范围：中成药、化学药；己是药品零售连锁企业所属门店，经营类别：处方药、甲类非处方药，乙类非处方药，经营范围：第二类精神药品、中成药、中药饮片，化学药。根据药品监督管理法规，结合题目提供的信息，关于药品销售行为的说法，正确的是
A. 甲将甲钴胺片销售给戊，戊同时销售给丁和己
B. 甲将甲钴胺片销售给乙，乙再销售给丁，丁再销售给己所属连锁总部，再由总部配送中心配送至己
C. 甲将甲钴胺片销售给丁，丁再销售给戊，丁、戊同时销售给己所属连锁总部，再由总部委托丁配送至己
D. 甲将甲钴胺片销售给丁，丁再直接销售并配送至己，己完成收货验收后向总部报告本次药品采购情况

正确答案：C。甲将甲钴胺片销售给丁，丁再销售给戊，丁、戊同时销售给己所属连锁总部，再由总部委托丁配送至己

解析：本题考查麻醉药品和精神药品购进渠道管理。甲是药品上市许可持有人，依法持有甲钴胺片等药品品种；乙是药品生产企业，生产范围：片剂，胶囊剂；丙是药品生产企业，生产范围：胶囊剂，颗粒剂；丁是全国性药品批发企业，经营范围：麻醉药品、中成药、中药饮片、化学药、生物制品，具备药品现代物流条件；戊是县级区域性药品批发企业，经营范围：中成药、化学药；己是药品零售连锁企业所属门店，经营类别：处方药、甲类非处方药，乙类非处方药，经营范围：第二类精神药品、中成药、中药饮片，化学药。根据药品监督管理法规，结合题目提供的信息，关于药品销售行为的说法，正确的是甲将甲钴胺片销售给丁，丁再销售给戊，丁、戊同时销售给己所属连锁总部，再由总部委托丁配送至己（C对）。区域性批发企业，可以从全国性批发企业购进麻醉药品和第一类精神药品。从事第二类精神药品批发业务的企业，可以将第二类精神药品销售给定点生产企业、具有第二类精神药品经营资格的药品批发企业、医疗机构、从事第二类精神药品零售的药品零售连锁企业。药品零售连锁企业对其所属的经营第二类精神药品的门店，应当严格执行统一进货、统一配送和统一管理。药品零售连锁企业门店所零售的第二类精神药品，应当由本企业直接配送，不得委托配送（D错）。